常用甘油作为溶剂的制剂是
A. 舌下片
B. 滴眼液
C. 漱口液
D. 滴耳液
E. 栓剂

正确答案：D。滴耳液

解析：本题考查药物制剂。常用甘油作为溶剂的制剂是滴耳液（D对）；舌下片（A错）指置于舌下，药物经舌下黏膜吸收而发挥全身作用的片剂；滴眼液（B错）属于眼用制剂；漱口液（C错）用于口腔，具有杀除微生物牙垢的功能；栓剂（E错）指药物与适宜基质制成的具有一定形状供腔道给药的固体外用制剂。